某药品生产企业利用回收玻璃瓶重新灌装大输液。根据《中华人民共和国药品管理法实施条例》，对本事件的处理，正确的有
A. 应按劣药论处
B. 应按假药论处
C. 药品监督管理部门没收这些玻璃瓶
D. 质量监督管理部门责令其停止使用
E. 按使用了未经批准的直接接触药品的包装材料和容器的行为进行处理

正确答案：A、C、D、E。应按劣药论处；药品监督管理部门没收这些玻璃瓶；质量监督管理部门责令其停止使用；按使用了未经批准的直接接触药品的包装材料和容器的行为进行处理

解析：本题考查药品管理。药品生产企业不得使用未经批准的直接接触药品的包装材料和容器，直接接触药品的包装材料和容器未经批准的按劣药论处（A对）。使用不合格的直接接触药品的包装材料和容器，药品监督管理部门应该予以没收（C对）。对不合格的直接接触药品的包装材料和容器，由药品监督管理部门责令停止使用（D对）。